下列疾病中最可能引起金黄色葡萄球菌肺脓肿的是
A. 鼻窦炎
B. 皮肤疖肿
C. 牙周脓肿
D. 食管穿孔
E. 膈下脓肿

正确答案：B。皮肤疖肿

解析：（一）吸入性肺脓肿可由于鼻窦炎、牙槽脓肿等脓性分泌物被吸入致病（AC错）。（二）继发性肺脓肿肺部邻近器官化脓性病变，如膈下脓肿、肾周围脓肿、脊柱脓肿或食管穿孔等波及到肺也可引起肺脓肿（DE错）。（三）血源性肺脓肿因皮肤外伤感染、疖、痈、中耳炎或骨髓炎等所致的脓毒症，菌栓经血行播散到肺，引起小血管栓塞、炎症和坏死而形成肺脓肿。致病菌以金黄色葡萄球菌（B对）、表皮葡萄球菌及链球菌为常见（P58）。